过量摄入可能导致先天畸形的是
A. 碘
B. 叶酸
C. 维生素A
D. 硫胺素
E. 烟酸

正确答案：C。维生素A